tRNA分子上3’-端序列的功能是
A. 辨认mRNA上的密码子
B. 剪接修饰作用
C. 辨认与核糖体结合的组分
D. 提供-OH基与氨基酸结合
E. 提供-OH基与糖类结合

正确答案：D。提供-OH基与氨基酸结合

解析：tRNA含有的茎环结构有DHU环、反密码环、TΨC环和氨基酸接纳茎。反密码环辨认mRNA上的密码子（A错）。TΨC环是辨认与核糖体结合的组分（C错）。氨基酸接纳茎即tRNA分子上3＇-端，其功能是提供-OH基与氨基酸结合（D对E错），生成氨基酰-tRNA。具有剪接修饰作用的主要是蛋白质，具有剪接修饰作用的RNA是snRNA（B错）。